下列关于类风湿因子（RF）与类风湿关节炎（RA）的描述，不正确的是
A. 高滴度RF阳性对诊断RA有意义
B. RF高滴度是RA预后不良的指标之一
C. RF阳性可见于RA以外的其他疾病
D. 部分RA患者的血清RF阴性
E. RF阳性是诊断RA的必备条件

正确答案：E。RF阳性是诊断RA的必备条件

解析：类风湿因子（RF）是一种自身抗体，高滴度RF阳性对诊断RA有意义（A对），而且是RA预后不良的指标之一（B对）。但RF并非RA的特异性抗体，它见于约70%RA患者血清，部分RA患者的血清RF阴性（D对），RF阳性可见于RA以外的其他疾病（C对）如干燥综合征、系统性红斑狼疮等，因此RF阳性不是诊断RA的必备条件（E错，为本题正确答案）。